TPP中所含的维生素是
A. 维生素B₁
B. 维生素B₂
C. 维生素C
D. 泛酸
E. 维生素PP

正确答案：A。维生素B₁

解析：TPP（焦磷酸硫胺素）中所含的维生素是维生素B₁（A对）；FAD（黄素腺嘌呤二核苷酸）和FMN（黄素单核苷酸）中所含的维生素是维生素B₂（B错）；维生素C（C错）存在于抗坏血酸中；CoA（辅酶A）和ACP（酰基载体蛋白）中所含的维生素是泛酸（D错）；NAD⁺（烟酰胺腺嘌呤二核苷酸）与NADPH⁺（烟酰胺腺嘌呤二核苷酸磷酸）中所含的维生素是维生素PP（E错）。